下列方剂组成药物中含有石膏与知母的是
A. 大定风珠
B. 消风散
C. 川芎茶调散
D. 地黄饮子
E. 羚角钩藤汤

正确答案：B。消风散

解析：大定风珠功能滋阴息风，由生白芍、阿胶、生龟板、干地黄、火麻仁、五味子、生牡蛎、麦冬、炙甘草、鸡子黄、鳖甲组成（A错）。消风散功能疏风除湿，清热养血，由当归、生地、防风、蝉蜕、知母、苦参、胡麻、荆芥、苍术、牛蒡子、石膏、甘草、木通组成（B对）。川芎茶调散功能疏风止痛，由薄荷叶、川芎、荆芥、细辛、防风、白芷、羌活、甘草组成（C错）。地黄饮子功能滋肾阴，补肾阳，开窍化痰，由熟干地黄、巴戟天、山茱萸、石斛、肉苁蓉、附子、五味子、肉桂、白茯苓、麦门冬、菖蒲、远志组成（D错）。羚角钩藤汤功能凉肝息风，增液舒筋，由羚角片，桑叶，川贝母，生地黄，钩藤，菊花，茯神，生白芍，生甘草，淡竹茹（E错）。趣记：消风散 朱妈通知老高，当地竞产牛子裤风。――术麻通知老膏，当地荆蝉牛子苦风。